毒性大，仅局部应用的抗病毒药是
A. 金刚烷胺
B. 利巴韦林
C. 阿昔洛韦
D. 阿糖胞苷
E. 碘苷

正确答案：E。碘苷